某女，30岁。咽痛干痒，有异物感，干咳少痰，颧红，潮热，耳鸣，多梦；舌红苔少，脉细数。宜选用的基础方剂是
A. 清咽利膈汤
B. 养阴清肺汤
C. 疏风清热汤
D. 半夏厚朴汤
E. 枇杷清肺饮

正确答案：B。养阴清肺汤

解析：本题考查的是咽喉肿痛的辨证论治。咽痛干痒，有异物感，干咳少痰，颧红，潮热，耳鸣，多梦；舌红苔少，脉细数。宜选用的基础方剂是养阴清肺汤（B对）。咽喉肿痛是以咽痛或咽部不适感，或咽部红肿为主要特征的咽喉部疾病。西医学的感冒、扁桃体炎、百日咳、咽喉炎等有咽喉肿痛者均可参考此内容辨证论治。（一）风热外袭证：【症状】咽部疼痛，逐渐加重，吞咽或咳嗽时疼痛加剧，咽部红肿，颌下有臖核；伴见发热恶风，头痛，咳嗽痰黄。舌质红，苔黄，脉浮数。【方剂应用】基础方剂为疏风清热汤（C错）（荆芥、防风、牛蒡子、甘草、金银花、连翘、桑白皮、赤芍、桔梗、黄芩、天花粉、玄参、浙贝母）加减。（二）火毒上攻证：【症状】咽喉疼痛红肿，吞咽困难，咽喉如梗，咽部红肿明显，颌下有臖核、压痛，伴发热，口渴喜饮，头痛剧烈，小便短赤，大便秘结。舌质红，苔黄，脉数有力。【方剂应用】基础方剂为清咽利膈汤（A错）（玄参、升麻、桔梗、甘草、茯苓、黄连、黄芩、牛蒡子、防风、芍药）加减。（三）虚火上炎证：【症状】咽部干燥，微痛，干痒，灼热，有异物感，干咳少痰，或痰中带血；或伴颧红潮热，耳鸣多梦。舌红，苔少，脉细数。【方剂应用】基础方剂为养阴清肺汤（玄参、甘草、白芍、麦冬、生地、薄荷、贝母、丹皮）或知柏地黄丸（知母、黄柏、生地、山药、茯苓、泽泻、丹皮、山茱萸）加减。半夏厚朴汤（D错）为郁证痰气郁结证的方剂应用。郁证痰气郁结证：【症状】精神抑郁，胸部闷塞，胁肋胀满，咽中如有物梗塞，咽之不下，咯之不出。舌苔白腻，脉弦滑。【方剂应用】基础方剂为半夏厚朴汤（半夏、厚朴、茯苓、生姜、苏叶）加减。枇杷清肺饮（E错）为粉刺肺经风热证的方剂应用。粉刺肺经风热证：【症状】丘疹色红，或有痒痛，或有脓疱；伴口渴喜饮，大便秘结，小便短赤。舌质红，苔薄黄，脉弦滑。【方剂应用】基础方剂为枇杷清肺饮（人参、枇杷叶、桑白皮、生甘草、黄连、黄柏）加减。